正常情况下，工作侧有尖牙保护（牙合）和组牙功能（牙合）两种咬合接触类型。非工作侧正常时应没有咬合接触，如果有妨碍工作侧咬合的接触，则应称为
A. 最大侧向颌位
B. 侧（牙合）颌位
C. 非工作侧（牙合）干扰
D. 侧向平衡（牙合）
E. 最大前伸颌位

正确答案：C。非工作侧（牙合）干扰

解析：正常情况下，工作侧有尖牙保护（牙合）和组牙功能（牙合）两种咬合接触类型。非工作侧正常时应没有咬合接触，如果有妨碍工作侧咬合的接触，则应称为非工作侧（牙合）干扰。掌握“下颌姿势位、三类颌位与前伸、侧方（牙合）颌位”知识点。